男，5岁，于夏季突然出现高热，2小时后抽搐，面色灰暗，四肢凉，血压下降，心肺未见异常，脑膜刺激征阴性。为确诊，应进一步检查
A. 血常规
B. 粪常规
C. 脑脊液
D. 脑电图
E. 头部CT

正确答案：B。粪常规

解析：5岁患儿（中毒型菌痢常见年龄），于夏季（菌痢高发季节）突然出现高热，2小时后抽搐，面色灰暗，四肢凉，血压下降，心肺未见异常，脑膜刺激征阴性（中毒性菌痢休克型临床表现），根据患儿的个人史和临床表现，最可能的诊断为中毒性细菌性痢疾，中毒性菌痢按临床表现可分为休克型、脑型、混合型三型。进一步确诊有赖于粪常规（B对），粪便镜检有大量白细胞（≥15个/高倍视野）、脓细胞及红细胞即可诊断。确诊有赖于粪便培养出痢疾杆菌。血常规（A错）为常规检测，不能用于确诊。中毒型菌痢的脑部病变主要是由于痢疾杆菌产生毒素造成，脑脊液检查（C错）并不能确诊。脑电图（D错）常用于检查神经系统疾病。头部CT（E错）主要用于检查颅内病变和脑外伤等。